急性胆囊炎可出现的是
A. 麦氏点压痛阳性
B. 墨菲征阳性
C. 液波震颤阳性
D. 振水音阳性
E. 移动性浊音阳性

正确答案：B。墨菲征阳性

解析：急性胆囊炎可出现的是墨菲征阳性（B对）。麦氏点压痛阳性见于急性阑尾炎（A错）。液波震颤阳性见于大量腹水（C错）。振水音阳性见于胃扩张或幽门梗阻（D错）。移动性浊音阳性见于腹腔积液（E错）。